葶苈子和桑白皮的共有功效是
A. 降气化痰
B. 泻肺平喘
C. 清肠疗痔
D. 润肠通便
E. 利水消肿

正确答案：B、E。泻肺平喘；利水消肿

解析：本题考查的是葶苈子与桑白皮的功效。葶苈子和桑白皮的共有功效是泻肺平喘（B对）与利水消肿（E对）。桑白皮：【功效】泻肺平喘，利水消肿。葶苈子：【功效】泻肺平喘，利水消肿。紫苏子：【功效】降气化痰（A错），止咳平喘，润肠通便。苦杏仁：【功效】降气止咳平喘，润肠通便（D错）。马兜铃：【功效】清肺化痰，止咳平喘，清肠疗痔（C错）。